大黄附子汤的主治证候中有
A. 大便稀溏
B. 腰膝酸软
C. 小便频数
D. 久痢赤白
E. 手足厥逆

正确答案：E。手足厥逆

解析：大黄附子汤功能温里散寒，通便止痛，主治因寒邪与积滞互结于肠道的寒积里实证。寒为阴邪，阴邪壅滞，阳气不能达于四肢，故手足厥逆（E对）。